硫酸奎宁的鉴别试验有
A. 在稀硫酸溶液中显蓝色荧光
B. 在稀氢氧化钠溶液中显蓝色荧光
C. 在微酸性水溶液中加溴试液和氨溶液即显翠绿色
D. 加入硫酸铜试液和20%的氢氧化钠溶液，显蓝紫色
E. 加入氯化钡试液，即生成白色沉淀；分离，沉淀在盐酸和硝酸中均不溶解

正确答案：A、C、E。在稀硫酸溶液中显蓝色荧光；在微酸性水溶液中加溴试液和氨溶液即显翠绿色；加入氯化钡试液，即生成白色沉淀；分离，沉淀在盐酸和硝酸中均不溶解